食管胸部前面邻接的结构是
A. 半奇静脉
B. 奇静脉
C. 胸主动脉
D. 胸导管
E. 左心房

正确答案：E。左心房

解析：食管胸部位于上纵隔后部和后纵隔，其毗邻结构有：（1）前方：气管、气管杈、左主支气管、左喉返神经、心包、左心房（E对）；（2）后方：胸主动脉、胸导管（D错）、奇静脉（B错）、半奇静脉（A错）；（3）左侧：左颈总动脉、主动脉弓、胸主动脉（C错）、胸导管上段；（4）右侧：奇静脉弓。